男，70岁。被诊断为抑郁障碍，某天得知其一位老友是心理治疗师，心想人好办事，逐向其求助，但却遭到了拒绝，该心理治疗师拒绝提供服务所依据的心理治疗原则为
A. 回避原则
B. 中立原则
C. 真诚原则
D. 耐心原则
E. 保密原则

正确答案：A。回避原则

解析：患者抑郁障碍，向心理治疗师好友求助，遭到了拒绝，该心理治疗师拒绝提供服务所依据的心理治疗原则为回避原则（A对）。中立原则（B错）指的是治疗者对治疗中涉及的各类事件均应保持客观、中立的立场，不把个人的观点强加于病人（P194）。